长期大量使用可致泌尿系统尿酸盐、半胱氨酸盐或草酸盐结石的维生素是
A. 维生素B₆
B. 维生素C
C. 维生素A
D. 维生素B₂
E. 维生素K

正确答案：B。维生素C

解析：本题考查维生素C。长期大量使用可致泌尿系统尿酸盐、半胱氨酸盐或草酸盐结石的维生素是维生素C（B对）。维生素B₆（A错）长期大量应用可致严重的周围神经炎、出现神经感觉异常。长期大量服用维生素A（C错）可引起慢性中毒。维生素B₂（D错）在正常肾功能状态下几乎不产生毒性，服用后尿呈黄色，但不影响继续用药。维生素K（E错）除个别病例有轻度一过性恶心或上腹部不适外，无明显副作用。